在神经-骨骼肌接头处，消除乙酰胆碱的酶是
A. 腺苷酸环化酶
B. ATP酶
C. 胆碱酯酶
D. 单胺氧化酶
E. Na⁺-K⁺依赖式ATP酶

正确答案：C。胆碱酯酶

解析：在终板膜表面分布有乙酰胆碱酯酶（C对），能将乙酰胆碱分解为胆碱和乙酸，使乙酰胆碱迅速消除。腺苷酸环化酶（A错）是催化ATP裂解去除焦磷酸形成cAMP的酶。ATP酶（B错）是一类能将ATP催化水解为ADP和磷酸根离子的酶。单胺氧化酶（D错）是催化单胺氧化脱氨反应的酶。Na⁺-K⁺依赖式ATP酶（E错）是钠泵，可维持细胞膜两侧Na⁺和K⁺电位差。